输注血小板的主要目的是
A. 增加血管致密度
B. 抑制纤溶活性
C. 改善止血功能
D. 降低抗凝功能
E. 加强凝血功能

正确答案：C。改善止血功能

解析：血小板的主要功能是参与生理止血。血小板通过促进血管收缩、形成血小板止血栓、释放凝血因子并为其激活提供磷脂表面等多种机制参与生理止血过程。输注血小板的主要目的就是改善止血功能（C对）。血小板促进血管收缩即增加了血管致密度。血小板中含有少量的α₂-抗纤溶酶，可抑制纤溶活性。凝血过程是一系列凝血因子被相继酶解激活的过程，活化的血小板一方面可释放纤维蛋白原等凝血因子，另一方面为凝血因子的激活提供磷脂表面，通过这两方面的作用大大加速了凝血过程。输注血小板可抵消血管内皮、肝素等抗凝物质对血小板聚集、激活的抑制作用，即降低抗凝功能。增加血管致密度、抑制纤溶活性、降低抗凝功能、加强凝血功能虽也属于输注血小板的目的，但其最终的目的都是为了改善止血功能（ABDE错）。